左侧视束完全损伤后出现
A. 双眼右侧视野偏盲
B. 双眼左侧视野偏盲
C. 双眼鼻侧视野偏盲
D. 患侧全盲
E. 无明显视觉障碍

正确答案：A。双眼右侧视野偏盲

解析：当视觉传导通路的不同部位受损时，可引起不同的视野缺损： 视网膜损伤引起的视野缺损与损伤的位置和范围有关； 一侧视神经损伤可致该侧眼视野全盲（D错）； 视交叉中交叉纤维损伤可致双眼视野颞侧半偏盲；一侧视束及以后的视觉传导路（视辐射、视区皮质）受损，可致双眼病灶对侧半视野同向性偏盲（如右侧受损则右眼视野鼻侧半和左眼视野颞侧半偏盲）（A对）。